由牙齿发育和（或）萌出过程中的某些异常所致的囊肿称为
A. 生长性牙源性囊肿
B. 浸润性牙源性囊肿
C. 癌性牙源性囊肿
D. 炎症性牙源性囊肿
E. 发育性牙源性囊肿

正确答案：E。发育性牙源性囊肿

解析：发育性牙源性囊肿由牙齿发育和（或）萌出过程中的某些异常所致。掌握“牙源性囊肿”知识点。